属于碳青霉烯类抗生素的是
A. 氨曲南
B. 克拉维酸
C. 哌拉西林
D. 亚胺培南
E. 他唑巴坦

正确答案：D。亚胺培南

解析：本题考查碳青霉烯类抗生素。碳亚胺培南（C对）是具有碳青霉烯结构的非典型β-内酰胺抗生素。氨曲南（A错）是单环β-内酰类。克拉维酸（B错）属于氧青霉烷类。哌拉西林（C错）为青霉素类。他唑巴坦（E错）为青霉烷砜类。